男，32岁。左下腹痛2个月。伴腹泻，大便为黄稀便，时有黏液血便，每日3次。查体：T36.5℃，P80次/分，R18次/分，BP120/80mmHg。双肺呼吸音清，未闻及干湿啰音，心率齐，腹软，左下腹轻压痛，无反跳痛。结肠镜检查：直肠、乙状结肠黏膜弥漫充血、水肿，粗颗粒样改变，多发糜烂及浅溃疡。最可能的诊断是
A. 结肠癌
B. 克罗恩病
C. 慢性结肠炎
D. 溃疡性结肠炎
E. 肠结核

正确答案：D。溃疡性结肠炎

解析：病人为年轻男性，腹痛，腹泻，粘液血便，结肠镜检查肠黏膜弥漫充血、水肿，粗颗粒样改变，多发糜烂及浅溃疡，符合溃疡性结肠炎的特征（D对）。结肠癌大多发生在老年人中，触诊多可发现肿块，结肠镜检查发现肿块做病理可以确诊（A错）。克罗恩病结肠镜下可见阿弗他溃疡或纵行溃疡，黏膜鹅卵石样改变，肠腔狭窄或肠壁僵硬，炎性息肉（B错）（P378）。肠结核腹泻多无脓血（E错）。